风痰上扰头痛、眩晕，治宜选用
A. 消风散
B. 二陈汤
C. 川芎茶调散
D. 天麻钩藤饮
E. 半夏白术天麻汤

正确答案：E。半夏白术天麻汤

解析：本题考查方剂的主治，属于理解记忆内容。“半夏白术天麻汤主治风痰上扰证，风痰上扰蒙蔽清阳，所以眩晕、头痛（E对）。消风散主治风疹、湿疹，不用于治疗风痰上扰头痛、眩晕（A错）。二陈汤主治湿痰证，不用于治疗风痰上扰头痛、眩晕（B错）。川芎茶调散主治外感风邪头痛，不用于治疗风痰上扰头痛、眩晕（C错）。天麻钩藤饮主治肝阳偏亢，肝风上扰证，不用于治疗风痰上扰头痛、眩晕（D错）。